黄嘌呤氧化酶的产物为
A. 尿酸
B. 尿囊素
C. 尿囊酸
D. 尿素
E. β氨基异丁酸

正确答案：A。尿酸